急性糜烂出血性胃炎最常见的原因是
A. 不洁饮食
B. 剧烈呕吐
C. 刺激性食物
D. 口服抗生素
E. 口服非甾体抗炎药

正确答案：E。口服非甾体抗炎药

解析：急性糜烂性出血性胃炎的常见病因有：1.应激；2.口服非甾体抗炎药（E对）；3.大量饮酒；4.十二指肠-胃反流；5.胃黏膜血液循环障碍。非甾体抗炎药抑制COX-1（环氧合酶1），导致维持黏膜正常再生功能的前列腺素E合成不足，黏膜修复障碍，出现糜烂和出血（P353）。不洁饮食（A错）常导致胃肠炎。剧烈呕吐（B错）易导致贲门撕裂综合征。刺激性食物（C错）可引起急性糜烂出血性胃炎，但不是最常见原因。口服大量抗生素（D错）易导致肠道菌群失调。